心脏骤停发生时最常见的心电图表现是
A. 室性停搏
B. 窦性停搏
C. 无脉电活动
D. 心房颤动
E. 心室颤动

正确答案：E。心室颤动

解析：心脏骤停（P316）时最常见的心电图表现是心室颤动（E对）。窦性停搏（B错）（P183）多见于窦房结变性与纤维化、急性下壁心机梗死、脑血管意外等病变或部分药物的使用。心房颤动（D错）（P188）可见于正常人，但多数见于原有心血管疾病患者。无脉电活动（C错）（P316）也属于导致心脏骤停的原因，但临床少见。持久性的室性停搏可引发阿-斯综合征。